适合手术治疗的高血压脑内血肿是
A. 丘脑出血，深昏迷
B. 内囊型血肿，深昏迷
C. 桥脑出血，深昏迷
D. 外侧型血肿，病情加重
E. 外侧型血肿，病情稳定

正确答案：D。外侧型血肿，病情加重

解析：高血压脑内血肿根据出血部位可以分为外侧型、内侧型和小脑型。外侧型位于内囊外侧（大脑皮质下及壳核），手术时对脑组织损伤较小，术后并发症较少。小脑型血肿位于小脑半球，易形成脑疝，宜尽早手术。因此对于外侧型及小脑型出血病情稳定（E错）的，可经短时间非手术治疗及密切观察，病情继续加重（D对）时应手术治疗。对于内侧型（丘脑、脑干）出血手术时脑组织受损严重，术后并发症多，不宜作为手术治疗的对象（ABC错）。病情重出现深昏迷（ABC错）以及高龄且有系统性疾病者（如心、肺、肝、肾等严重疾病），不宜作手术治疗。